构成
A. 由外膜、脉络膜和内膜
B. 由纤维膜、血管膜和视网膜
C. 由角膜、脉络膜和视网膜
D. 由巩膜、脉络膜和内膜
E. 角膜、巩膜和睫状体

正确答案：B。由纤维膜、血管膜和视网膜

解析：眼球壁由纤维膜、血管膜和视网膜（B对）构成。